患者，女，55岁。经皮冠状动脉介入治疗（PCI）术后一直服用他汀类药物，但是低密度脂蛋白胆固醇（LDL-C）未达标，医师增加了他汀类药物的剂量后，患者的ALT升至120U/L，故医师拟恢复原他汀药物的剂量，并联用其他调血脂药，该患者宜联用的药物是
A. 依折麦布
B. 非诺贝特
C. 辛伐他汀
D. 氟伐他汀
E. 瑞舒伐他汀

正确答案：A。依折麦布

解析：本题考查药物的选择。该患者宜联用的药物是依折麦布（A对）。依折麦布属于胆固醇吸收抑制剂，是当前使用他汀类药物不耐受或单独使用他汀类药物治疗不达标时的首选二线用药，而且依折麦布几乎不会引起转氨酶升高，因此此时患者适合联用依折麦布。非诺贝特（B错）应慎与HMG-CoA还原酶抑制剂，如普伐他汀、氟伐他汀（D错）、辛伐他汀（C错）、瑞舒伐他汀（E错）等合用，可引起肌痛、横纹肌溶解、血肌酸磷酸激酶增髙等肌病。